男，46岁。从事熟食烘干工作25年近期出现视物模糊，确诊为白内障。最可能的致病原因是
A. 微波
B. 铅
C. 苯胺
D. 拟除虫菊酯
E. 紫外线辐射

正确答案：A。微波

解析：熟食烘焙工作者，长期处在微波烤箱的工作环境中，微波（A对）辐射引起的眼晶状体浑浊，少数接触大功率微波辐射者，甚至可发展为白内障。铅（B错）、苯胺（C错）和拟除虫菊酯（D错）不是食品加工从业者经常接触的物品。紫外线辐射（E错）也是白内障的主要诱因，但是是卫生医疗系统从业者常见的致病原因，这与本题中患者的工作情况不符。